与四氢硼钠反应呈红色至紫色的是
A. 二氢黄酮
B. 黄酮醇
C. 黄烷
D. 5-羟基黄烷
E. 4-羟基黄烷

正确答案：A。二氢黄酮

解析：本题考查的是黄酮类化合物的鉴别反应。与四氢硼钠反应呈红色至紫色的是二氢黄酮（A对）。黄酮类化合物的四氢硼钠（钾）反应：在黄酮类化合物中，NaBH₄对二氢黄酮类化合物专属性较高，可与二氢黄酮类化合物反应产生红色至紫色。其他黄酮类化合物均不显色，可与之区别